某男性患者，29岁，体健。诉牙龈自发出血1月，熬夜3天后出血严重并伴有牙龈疼痛和口臭，伴有低热和全身乏力。最可能的诊断是急性坏死性溃疡性龈炎。若诊断为急性坏死性溃疡性龈炎，最有价值的辅助检查是菌斑涂片。若诊断为急性坏死性溃疡性龈炎，它的致病菌主要是梭形杆菌和螺旋体。此患者首诊最佳治疗措施是
A. 口服抗生素
B. 保守治疗，先进行各项辅助检查以确诊
C. 尽量除浄牙石及刺激物，3%双氧水冲洗
D. 口腔卫生宣教，先用1%双氧水含漱3天
E. 去除大块牙石及坏死物，3%双氧水冲洗

正确答案：E。去除大块牙石及坏死物，3%双氧水冲洗

解析：本题考查急性坏死性溃疡性龈炎的治疗。急性期应首选轻轻去除牙龈乳头及龈缘的坏死组织，并初步去除大块的龈上牙石，3%双氧水冲洗（E对）。重症患者可使用抗生素（A错）。急性坏死性溃疡性龈炎结合临床表现不难确诊，不必先进行各项辅助检查（B错）。对患者进行口腔卫生宣教（D错）、尽量除浄牙石及刺激物，3%双氧水冲洗（C错）属于急性坏死性溃疡性龈炎的治疗方法但不是首选。且尽量除浄牙石及刺激物应在急性期过后。